城市给水水源一般应设在
A. 生活居住区
B. 工业区
C. 对外交通运输区
D. 仓库区
E. 郊区

正确答案：E。郊区

解析：本题考查城市给水水源的设置。城市的给水水源、污水处理厂、垃圾处理厂和填埋场、火葬场、墓地、机场、铁路编组站、仓库等一般均设在郊区（E对ABCD错）。